卵巢纤维瘤常伴什么综合征
A. 美尼尔综合征
B. 希恩综合征
C. 梅格斯综合征
D. turner综合征
E. 类癌综合征

正确答案：C。梅格斯综合征

解析：卵巢纤维瘤常伴梅格斯综合征（C对），即纤维瘤伴有腹腔积液和（或）胸腔积液。美尼尔综合征（A错）是一种特发性膜迷路积水的内耳病，表现为反复发作的旋转性眩晕，波动性感音神经性听力损失，耳鸣和（或）耳胀满感。希恩综合征（B错）是由于产后大出血休克，导致垂体尤其是腺垂体促性腺激素分泌细胞缺血坏死，引起腺垂体功能低下而出现一系列的症状。Turner综合征（D错）是最为常 见的性发育异常，其主要病变为卵巢不发育伴有体格发育异常。类癌综合征（E错）表现为喘息、皮肤潮红、水样腹泻、阵发性心动过速等，多见于SCLC和腺癌。